某男，53岁。关节疼痛、肿大、僵硬变形。诊断为痹证，证属尪痹（肝肾亏损、风湿阻络）。给予尪痹颗粒，开水冲服，一次6g，一日3次；近日，患者又因劳累后出现腰痛，腰膝酸冷，四肢欠温，加服桂附地黄丸，一次6g，一日2次。上述治疗方案存在的问题是
A. 诊断与用药不符
B. 中成药联用存在有毒成分叠加
C. 桂附地黄丸存在证候禁忌
D. 桂附地黄丸超剂量
E. 尪痹颗粒超剂量

正确答案：B。中成药联用存在有毒成分叠加

解析：本题考查中成药联用的配伍禁忌。上述治疗方案存在的问题是中成药联用存在有毒成分叠加（B对）。含有毒药物中成药的联用：数种功效相似的中成药联用，在各自制剂的组成中，往往有一种或几种相同的药味。因此，联用将会增加某一味或几味药的剂量。如大活络丸与天麻丸合用，两者均含附子；朱砂安神丸与天王补心丸合用，两者均含朱砂，均会增加有毒药味的服用量，加大患者产生不良反应的危险性。故在使用时应考虑药物“增量”的因素。再如复方丹参滴丸和速效救心丸同属气滞血瘀型用药，其处方组成与功效基本相似，而且这一类的药物多数含有冰片，由于冰片药性寒凉，服用剂量过大易伤人脾胃，导致胃痛胃寒，故不可过量使用，在临床应用中使用其中一种即可。因此中成药之间的联合用药。尤其是几种含有有毒成分或相同成分的中成药联合应用时，应注意有毒成分或相同成分的“叠加”，以免引起不良反应。尪痹颗粒与桂附地黄丸中均含有附子，不可过量、久用，又属于重复用药，不宜联用。结合患者症状为痹症之尪痹。痹症之尪痹【症状】痹证日久不愈，肢体、关节疼痛，屈伸不利，关节肿大僵硬、变形，甚则肌肉萎缩，筋脉拘急，肘膝不伸，或以尻代踵，以背代头，伴腰膝酸软、骨蒸潮热、自汗、盗汗。舌红或淡，脉细数。【中成药应用】常用药为天麻丸、独活寄生合剂、尪痹颗粒、益肾蠲痹丸。诊断与用药符合（A错）。合理用药指导：孕妇禁用腰痛片；慎用左归丸、鱼鳔丸、七宝美髯丸、杜仲补天素片、桂附地黄丸和济生肾气丸。肺热津伤、胃热炽盛、阴虚内热消渴者慎用桂附地黄丸。桂附地黄丸不存在证候禁忌（C错）。桂附地黄丸用法用量：口服。一次6g，一日2次（D错）。尪痹颗粒用法用量：开水冲服，一次6g。一日3次（E错）。